下列各项，属实热证的是
A. 头颅过大
B. 头颅过小
C. 囟填
D. 囟陷
E. 解颅

正确答案：C。囟填

解析：囟填，多属实热证，多因温病火邪上攻，或脑髓有病，或颅内水液停聚所致（C对）。头颅过大，多属先天不足，神经亏损，水液停聚于脑所致（A错）。头颅过小，多因肾精不足，颅脑发育不良所致（B错）。囟陷，多属虚证，多因吐泻伤津，气血不足和先天肾精亏虚，脑髓失充所致（D错）。解颅，即囟门迟闭。多因肾气不足，发育不良所致，多见于佝偻病患儿，且常兼有“五软”“五迟”等症状（E错）。